全社会应当尊重医师，医师依法履行职责时应受
A. 全社会监督
B. 法律保护
C. 医疗机构的保护
D. 卫生行政部门保护
E. 群众支持

正确答案：B。法律保护

解析：全社会应当尊重医师，医师依法履行职责时应受法律保护。医师应当具备良好的职业道德和医疗执业水平，发扬人道主义精神，履行防病治病、救死扶伤、保护入民健康的神圣职责。全社会应当尊重医生，医师依法履行职责受法律保护（B对）。